成人术前需要应用降压药的血压（mmHg）指标是超过
A. 130/90
B. 140/90
C. 150/100
D. 160/100
E. 170/110

正确答案：D。160/100

解析：严重高血压患者在麻醉、手术过程中极易诱发脑血管意外、心力衰竭等严重并发症，因此血压过高者（超过180/100mmHg），术前应选用合适的降压药物，使血压平稳在一定水平，但不要求降至正常后才做手术。若血压在160/100mmHg（D对）以下，可不必作特殊准备。